患者，男，69岁，患高血压20年，高脂血症10年，冠心病5年。1个月前因急性心肌梗死，于前降支植入一枚药物洗脱支架。该患者于支架植入术后2个月出现柏油便，Hb60g/L，考虑消化道大出血。在立即给予抑酸、止血和支持治疗的同时，对抗血小板方案进行调整，正确的方案是
A. 立即停用所有抗血小板药物
B. 降低现用抗血小板药物的剂量
C. 换用其他抗血小板药物
D. 换用口服抗凝药
E. 换用低分子肝素皮下给药

正确答案：A。立即停用所有抗血小板药物

解析：本题考查抗血小板治疗。患者出现大出血，应立即停用所有抗血小板药物（A对）。发生消化道损伤时是否停用抗血小板药物，需根据消化道损伤的风险和心血管疾病的风险进行个体化评价。如果患者仅表现为消化不良症状，可不停用抗血小板药物而给予抑酸药；如患者发生活动性出血，常需停用抗血小板药物直到出血情况稳定。但某些患者因停用抗血小板药物会增加血栓栓塞事件风险，尤其是急性冠状动脉综合征（ACS）、植入裸金属支架1个月内、药物涂层支架6个月内的患者，建议尽量避免完全停用抗血小板药物。患者联合使用多种抗血小板和抗凝药物时，如果发生出血，应考虑减少药物种类和剂量（B错）。